患者，男，30岁，在5年前因露阴癖而被抓劳教，放出来后，其观念仍顽固地存在，强烈要求进行心理治疗。对于该患者较适宜的心理治疗方法为
A. 自由联想
B. 梦的分析
C. 厌恶治疗
D. 系统脱敏
E. 生物反馈

正确答案：C。厌恶治疗